女，反复咳嗽多年，今日突发咯血200毫升，之前偶有咯血，胸片提示多发囊状改变，病变局限于肺段，目前治疗首选
A. 静滴垂体后叶素
B. 肺叶切除手术
C. 抗生素治疗
D. 支气管动脉栓塞
E. 静滴氨甲环酸

正确答案：B。肺叶切除手术

解析：患者女，出现多年的反复咳嗽，突发咯血200毫升，之前偶有咯血（支气管扩张症的临床表现），胸片提示多发囊状改变（支气管扩张症的影像学表现），病变局限于肺段，结合患者的表现和辅助检查，诊断为支气管扩张症，目前治疗首选肺叶切除手术（B对）。“咯血的治疗 对反复咯血的病人，如果咯血量少，可以对症治疗或口服卡巴克洛（安络血）或云南白药。若出血量中等，可静脉给予垂体后叶素或酚妥拉明；若出血量大，经内科治疗无效，可考虑介入栓塞治疗或手术治疗，局限性用肺段切除术，多出或散在用栓塞治疗。使用垂体后叶素需要注意低钠血症的产生”（AE错）。控制支气管扩张症病人出现痰量增多及其脓性成分增加等急性感染征象时，需应用抗感染药物。急性加重期开始抗菌药物治疗前应常规送痰培养，根据痰培养和药敏结果指导抗生素应用，但在等待培养结果时即应开始经验性抗菌药物治疗（C错）。支气管动脉栓塞不属于目前的首选治疗（D错）。